有主水和纳气功能的脏是
A. 肝
B. 心
C. 脾
D. 肺
E. 肾

正确答案：E。肾

解析：肾（E对）的主要生理机能是主藏精，主水，主纳气。肝（A错）的主要生理机能是主疏泄与主藏血。心（B错）的生理机能是主血脉，主藏神；脾（C错）的主要生理机能是主运化与主统血。肺（D错）的主要生理机能是主气司呼吸，主行水，朝百脉，主治节。